男36岁。诊断抑郁症，服用帕罗西汀40mg/d治疗6个月，症状完全缓解4个月。2天前患者自行停药，目前出现头晕、恶心、坐立不安、站立不稳。最可能的原因是
A. 恶性综合症
B. 原有焦虑症状复发
C. 原有抑郁症状复发
D. 5-HT综合症
E. 帕罗西汀停药反应

正确答案：E。帕罗西汀停药反应

解析：该男性患有抑郁症，服用帕罗西汀（为选择性5-羟色胺再摄取抑制剂（SSRIs））6个月，头晕、恶心、坐立不安、站立不稳，患者2天前自行停药，故该患者最有可能的诊断是帕罗西汀停药反应（E对）。恶性综合症（P232）表现为意识波动、肌肉强直、高热和自主神经功能不稳定，最常见于氟哌啶醇、氯丙嗪和氟奋乃静等药物治疗，可以发现肌酸磷酸激酶浓度升高，与本例不符，故不考虑（A错）。5-HT综合症常在与 MAOIs等药合用的时候发生（D错）。